上颌骨不参与以下哪个解剖结构的构成
A. 翼上颌裂及眶下裂
B. 口腔顶和鼻腔底
C. 鼻腔侧壁
D. 颞下窝和翼腭窝
E. 颞窝

正确答案：E。颞窝

解析：颞下窝是上颌骨体和颧骨后方的不规则间隙，容纳咀嚼肌和血管神经等，向上通颞窝。窝前壁为上颌骨体和颧骨，内壁为翼突外侧板，外壁为下颌支，下壁与后壁空缺。此窝向上借卵圆孔和棘孔与颅中窝相通。向前借眶下裂通眶，向内借上颌骨与蝶骨翼突之间的翼上颌裂通翼腭窝。掌握“上颌骨解剖特点”知识点。